蒙医认为，妊娠禁用药应包括
A. 毒剧类药
B. 刺激性药
C. 利尿类药
D. 峻烈泻剂
E. 稀血破痞类药

正确答案：A、B、D、E。毒剧类药；刺激性药；峻烈泻剂；稀血破痞类药

解析：本题考查的是蒙药的妊娠禁忌用药。蒙医认为，妊娠禁用药应包括毒剧类药（A对）、刺激性药（B对）、峻烈泻剂（D对）与稀血破痞类药（E对）。蒙药的妊娠用药禁忌：一般毒剧、刺激性药、峻烈泻剂和具有稀血、破痞功能的药孕妇禁用；缓泻剂和具有利尿（C错）、活血化瘀功能的药孕妇慎用。